丘脑的非特异性投射系统的主要作用是
A. 引起触觉
B. 调节内脏活动
C. 引起牵涉痛
D. 维持睡眠状态
E. 维持大脑皮质的兴奋状态

正确答案：E。维持大脑皮质的兴奋状态